女，55岁。风湿性心脏瓣膜病二尖瓣狭窄15年，心房颤动1年。无活动后心悸和气短，无夜间阵发性呼吸困难，既往无高血压、糖尿病、脑血管疾病史。超声心动提示左房内径5.3cm。患者抗栓治疗的首选药物是
A. 华法林
B. 潘生丁
C. 氯吡格雷
D. 阿司匹林
E. 替罗非班

正确答案：A。华法林

解析：二尖瓣狭窄合并房颤时，血栓栓塞发生率高，因此应常规抗栓治疗。目前二尖瓣狭窄患者抗栓治疗的首选药物是华法林（A对），服药期间需维持INR在2.5～3.0之间，能安全有效地预防脑卒中的发生。潘生丁（九版药理学P267）（B错）又称双嘧达莫，主要用于人工心脏瓣膜置换术后、缺血性心脏病、脑卒中和短暂性脑缺血发作，防止血小板血栓形成。氯吡格雷（P232）（C错）目前多用于急性冠脉综合征的抗血小板治疗。阿司匹林（D错）可用于房颤患者的抗栓治疗，但一般仅在无心脏瓣膜病变或CHADS₂=1时考虑使用（八版内科学P189-P190），本例患者有二尖瓣狭窄病史，故不能使用阿司匹林。替罗非班（P233）（E错）为人工合成的血小板糖蛋白Ⅱb/Ⅲa受体拮抗剂，主要用于计划接受PCI术的UA/NSTEMI患者。